某男，62岁，反复左脚跖趾关节红肿热痛2个月。昨晚此关节红肿明显，疼痛剧烈，并伴发热。该男子每天膳食嘌呤摄入量应为
A. ＜150mg/d
B. 200mg/d
C. 250mg/d
D. 400mg/d
E. 600mg/d

正确答案：A。＜150mg/d

解析：本题考查痛风病人膳食嘌呤摄入量。本题中该男子反复左脚跖趾关节红肿热痛，昨晚此关节红肿明显，疼痛剧烈，并伴发热。可知该男子为痛风急性发作，应选择低嘌呤饮食，其每天膳食嘌呤摄入量应为＜150mg/d（A对BCDE错）。